督脉的主要生理功能是
A. 总督一身之阴经
B. 总督一身之阳经
C. 分主一身左右之阴阳
D. 约束诸经
E. 调节十二经气血

正确答案：B。总督一身之阳经

解析：督脉功能：①调节阳经气血，为“阳脉之海”（B对）。②反映脑、髓和肾的功能。任脉功能：①调节阴经气血，为“阴脉之海”（A错）。②任主胞胎。冲脉功能：①调节十二经脉气血（E错）。②与女子月经及生殖功能有关。带脉功能：①约束纵行诸经（D错）。②主司妇女带下。跷脉分为阴跷脉和阳跷脉，各主一身左右之阴和阳，调和阴阳，司眼睑开合（C错）。